艾滋病病人发生在口腔的与感染有关的病损包括
A. 口腔念珠菌病
B. 口腔毛状黏膜白斑
C. 卡波西肉瘤
D. 与艾滋病相关的牙周炎
E. 以上均是

正确答案：E。以上均是

解析：本题考查HIV感染的口腔表现。HIV感染的口腔表现：1.真菌感染：口腔念珠菌病（A对）、组织胞浆菌病；2.病毒感染：毛状白斑（B对）、单纯疱疹、带状疱疹、巨细胞病毒感染、乳头状瘤、局灶性上皮增生；3.卡波西肉瘤（C对）；4.与HIV相关性牙周病（D对）；5.坏死性口炎；6.溃疡性损害；7.唾液腺疾病；8.非霍奇金淋巴瘤。（ABCD均对，故E为本题的正确答案）。